天疱疮属于
A. 过敏性疾病
B. 自身免疫病
C. 免疫缺陷病
D. 感染性疾病
E. 传染性疾病

正确答案：B。自身免疫病

解析：本题考查天疱疮。天疱疮是自身免疫疾病（B对），天疱疮特征性的病变是患者的上皮棘细胞间存在抗黏接的抗原抗体反应，而导致上皮松解和疱性损害的发生。接触性口炎属于过敏性疾病（A错）；艾滋病是一种免疫缺陷病（C错），同时，它既是感染性疾病（D错）也是传染性疾病（E错）。